缺O₂引起的呼吸加深加快主要是通过什么刺激器引起的
A. 直接刺激呼吸中枢
B. 刺激中枢化学感受器转而兴奋呼吸中枢
C. 刺激主动脉弓、颈动脉窦压力感受器
D. 刺激主动脉体、颈动脉体压力感受器
E. 刺激主动脉体、颈动脉体化学感受器

正确答案：E。刺激主动脉体、颈动脉体化学感受器